发生结核性胸腔积液的患者，首要处理原则是
A. 糖皮质激素治疗
B. 积极控制感染
C. 注入滑石粉
D. 外科手术
E. 尽快抽尽胸腔积液

正确答案：E。尽快抽尽胸腔积液

解析：发生结核性胸腔积液的患者，首要处理原则是尽快抽尽胸腔积液（E对），因为结核性胸膜炎胸水蛋白含量高，容易引起粘连，抽液后不仅可解除肺及心血管受压状态，改善呼吸及循环，还可减轻中毒症状。糖皮质激素治疗（A错）可减轻结核中毒症状，但可导致结核菌的播散，仅用于全身毒性症状严重、大量胸水的患者。积极控制感染（B错）不是该患者的首要处理原则，只有当结核性胸腔积液的患者并发感染，才需积极控制感染。注入滑石粉（C错）可防止胸腔粘连，但不能改善呼吸及循环，并不是首要的处理原则。外科手术（D错）不是结核性胸腔积液的治疗方法。